很少引起AIDS患者机会性感染的病原体是
A. EB病毒
B. 弓形虫
C. 新型隐球菌
D. 卡氏肺孢子虫
E. 巨细胞病毒

正确答案：A。EB病毒

解析：多发机会性感染是AIDS（艾滋病）的特点之一，肺部机会性感染最常见的病原体是卡氏肺孢子虫（D对）；中枢神经系统常见的病原体有弓形虫（B对）、新型隐球菌（C对）、巨细胞病毒（E对）和乳头状瘤空泡病毒。EB病毒（A错，为本题正确答案）主要与Burkitt淋巴瘤等疾病有关，很少引起AIDS患者机会性感染。